在我国，社会医学是从何分化发展起来的
A. 临床医学
B. 社会学
C. 预防医学
D. 生理学
E. 病理学

正确答案：C。预防医学

解析：本题考查社会医学的分化发展。在我国，社会医学是从预防医学（C对ABDE错）分化发展起来的。